继发性腹膜炎毒性强的原因主要是因为感染菌为
A. 金黄色葡萄球菌
B. 溶血性链球菌
C. 大肠杆菌
D. 各种细菌混合
E. 绿脓杆菌

正确答案：D。各种细菌混合

解析：继发性腹膜炎是最常见的腹膜炎，其毒性强主要是因为各种细菌混合感染（D对）所致。金黄色葡萄球菌（A错）、溶血性链球菌（B错）、大肠杆菌（大肠埃希菌）（C错）、绿脓杆菌（铜绿假单胞菌）（E错）等单一细菌引起的感染毒性较弱。注意：大肠杆菌是继发性腹膜炎的最常见致病菌。